流行性出血热少尿期尿量为
A. 少于400mL
B. 少于1000mL
C. 超过1500mL
D. 超过2000mL
E. 超过3000mL

正确答案：A。少于400mL

解析：流行性出血热少尿期主要表现为少尿（24小时尿量少于400mL）（A对）或无尿（24小时尿量少于100mL）。流行性出血热多尿早期每日尿量超过2000mL（D错），氮质血症无明显改善，症状仍重。流行性出血热多尿后期每日尿量超3000mL（E错），并逐日增加。